患儿，3岁。不思进食，泛恶，夜间哭闹，少寐，腹胀，舌苔厚腻垢浊。其诊断是
A. 厌食
B. 积滞
C. 疳证
D. 口疮
E. 夜啼

正确答案：B。积滞

解析：本病患儿除不思进食外，尚可见腹胀，舌苔厚腻垢浊等积滞内停之象，故诊断为积滞（B对）——积滞是指小儿内伤乳食，停聚中焦，积而不化，气滞不行所形成的一种胃肠疾患，以不思乳食，食而不化，脘腹胀满，嗳气酸腐，大便溏薄或秘结酸臭为临床特征。乳食积滞中焦，脾运失司，气机失畅，故不思进食；胃气上逆，则泛恶；胃肠不适，则夜间哭闹，少寐；中焦气机阻滞，则腹胀，故诊断为积滞。厌食是小儿临床以较长时期的食欲减退或消失，厌恶进食，食量减少为特征，一般无脘腹胀满、大便酸臭等症（A错）。疳证（C错）临床表现以形体消瘦，饮食异常，面黄发枯，精神萎靡或烦躁不安为特征。口疮（D错）即疱疹性口炎，以口腔内出现单个或成簇小疱疹为主要临床特征的口腔炎症，多见于1～3岁小儿。夜啼（E错）是指婴幼儿入夜啼哭不安，时哭时止，或每夜定时啼哭，甚则通宵达旦，但白天能安静入睡的一种病证。